中药饮片切段的长度为
A. 10～15mm
B. 5～8mm
C. 16～18mm
D. 3～4mm
E. 1～2mm

正确答案：A。10～15mm